医务人员应该尊重患者的人格权，其中不包括的是
A. 人的生命权
B. 患者姓名权
C. 人格尊严权
D. 家庭财产权
E. 患者隐私权

正确答案：D。家庭财产权

解析：医务人员应该尊重患者的人格权，其中包括人的生命权、患者姓名权、人格尊严权、患者隐私权等（D错，为本题正确答案）。